下列哪种情况下去除外界刺激因素后牙髓炎症有恢复的可能
A. 根尖孔粗大，牙髓炎症轻微，全身情况良好
B. 刺激强度并不很强或刺激减弱但长期存在时
C. 当牙髓炎症渗出物得到某种程度的引流时
D. 外界刺激较强且持续长期存在使牙髓炎症发展时
E. 以上情况均可

正确答案：A。根尖孔粗大，牙髓炎症轻微，全身情况良好

解析：本题考查牙髓的解剖生理。根尖孔粗大，牙髓炎症轻微，全身情况良好（A对），牙髓血运丰富代偿能力强，机体抵抗力强，能抵抗牙髓轻微炎症，有可能促进牙髓炎症恢复。刺激强度并不很强或刺激减弱但长期存在时（B错），会使牙髓以慢性牙髓炎状态炎续存在，牙髓炎症不会恢复。当牙髓炎症渗出物得到某种程度的引流时（C错），此时虽然根管内压力减轻，但此时因化脓感染坏死的牙髓组织部不可能再恢复活力。外界刺激较强且持续长期存在使牙髓炎症发展时（D错），牙髓在短时间内很快变性失活，牙髓炎症不可能恢复。